临床使用双黄连注射剂应特别监护的严重不良反应
A. 过敏性休克
B. 血管神经性水肿
C. 剥落性皮炎
D. 重症多形性红斑
E. 支气管痉挛

正确答案：A、B、C、D、E。过敏性休克；血管神经性水肿；剥落性皮炎；重症多形性红斑；支气管痉挛

解析：本题考查的是双黄连注射剂不良反应表现。临床使用双黄连注射剂应特别监护的严重不良反应过敏性休克（A对）、血管神经性水肿（B对）、剥落性皮炎（C对）、重症多形性红斑（D对）与支气管痉挛（E对）。双黄连注射剂不良反应表现：全身性损害主要表现为过敏性休克、过敏样反应、高热、寒战等，呼吸系统损害主要表现为呼吸困难、呼吸急促、喉头水肿、支气管痉挛等；皮肤及其附件损害表现为药疹、血管神经性水肿、剥脱性皮炎、重症多形性红斑等；其他损害包括肝功能损害、血尿、肾功能损害、过敏性紫癜、血压下降、视觉异常、听觉异常、抽搐、惊厥、昏迷等。